下列属于胰岛素不良反应的是
A. 低血糖
B. 胰岛素抵抗
C. 共济失调
D. 过敏反应
E. 组织缺水

正确答案：A、B、C、D。低血糖；胰岛素抵抗；共济失调；过敏反应

解析：本题考查胰岛素的不良反应。属于胰岛素不良反应的是低血糖（A对）、胰岛素抵抗（B对）、共济失调（C对）、过敏反应（D对）。胰岛素能够使血糖降低，过量使用会造成低血糖；同时具有依赖性，长期大量使用会使机体对胰岛素敏感下降，发生胰岛素抵抗。胰岛素过量会致饥饿感、精神不安，严重的可出现共济失调。胰岛素的过敏反应少见，表现为荨麻疹等，偶见危及生命的过敏性休克。